切除肿瘤后胸水、腹水可自行消失的卵巢肿瘤是
A. 库肯勃瘤
B. 纤维瘤
C. 无性细胞瘤
D. 畸胎瘤
E. 浆液性癌

正确答案：B。纤维瘤

解析：纤维瘤（B对）伴有腹腔积液或胸腔积液者，称为梅格斯综合征，手术切除肿瘤后，胸腔积液、腹腔积液自行消失。库肯勃瘤（P331）（A错）又称印戒细胞癌，是一种特殊的卵巢转移性腺癌，镜下见典型印戒细胞。无性细胞瘤（P329）（C错）和畸胎瘤（P329）（D错）同属于卵巢生殖细胞肿瘤，前者是卵巢恶性肿瘤，对放疗敏感；后者可分为成熟畸胎瘤和未成熟畸胎瘤，两者均无胸腹水形成。浆液性癌（P326）（E错）属于卵巢上皮性肿瘤，好发于双侧，体积较大，囊实性，切面为多房，腔内充满乳头，质脆，易出血坏死。